细菌细胞壁特有的成分是
A. 肽聚糖
B. 外膜
C. 脂蛋白
D. 脂多糖
E. 类脂A

正确答案：A。肽聚糖

解析：肽聚糖或称作黏肽，为细胞壁的主要成分，由N-乙酰葡萄糖胺与N-乙酰胞壁酸借β-1，4糖苷键连接为聚糖骨架，再与四肽侧链及五肽交联桥共同构成。肽聚糖为细菌所特有，在革兰氏阳性（G+）菌与革兰氏阴性（G-）菌，肽聚糖的构成有所不同。掌握“细菌的大小、形态和基本结构”知识点。